具有稳定TCR结构及转导T细胞活化信号作用的是
A. CD2
B. CD3
C. CD4
D. CD28
E. CD40

正确答案：B。CD3

解析：TCR通过其跨膜区与CD3分子的跨膜区连接，形成TCR-CD3复合体。CD3由5种肽链组成。TCR识别抗原所产生的活化信号由CD3分子传导至T细胞内。掌握“B淋巴细胞”知识点。